表面具“砂眼”，根头有“珍珠盘”的药材是
A. 地榆
B. 银柴胡
C. 南沙参
D. 桔梗
E. 续断

正确答案：B。银柴胡

解析：本题考查的是银柴胡药材的性状鉴别。表面具“砂眼”，根头有“珍珠盘”的药材是银柴胡（B对）。银柴胡：【性状鉴别】药材呈类圆柱形，偶有分枝。表面浅棕黄色至浅棕色，有扭曲的纵皱纹及支根痕，多具孔穴状或盘状凹陷，习称“砂眼”，从砂眼处折断可见棕色裂隙中有细砂散出。根头部略膨大，有密集的呈疣状突起的芽苞、茎或根茎的残基，习称“珍珠盘”。质硬而脆，易折断，断面不平坦，较疏松，有裂隙，皮部甚薄，木部有黄、白色相间的放射状纹理。气微，味甘。地榆（A错）：【性状鉴别】药材呈不规则纺锤形或圆柱形，稍弯曲。表面灰褐色至暗棕色，具纵皱纹，粗糙。质硬，折断面较平坦，略显粉质，皮部淡黄色，木部粉红色或淡黄色，有放射状纹理。气微，味微苦而涩。南沙参（C错）：【性状鉴别】药材呈圆锥形或圆柱形，略弯曲。表面黄白色或淡棕黄色，凹陷处常有残留粗皮，上部多有深陷横纹，呈断续的环纹，下部有纵纹及纵沟。顶端具1或2个根茎。体轻，质松泡，易折断，断面不平坦，黄白色，多裂隙。气微，味微甘。桔梗（D错）：【性状鉴别】药材呈圆柱形或略呈纺锤形，下部渐细，有的有分支，略扭曲。表面淡黄色至黄色，不去外皮的表面黄棕色至灰棕色，具纵扭皱沟，并有横长的皮孔样斑痕及支根痕，上部有横纹。有的顶端有较短的根茎或不明显，其上有数个半月形茎痕。质脆，断面不平坦，横切面可见放射状裂隙，皮部黄白色，形成层环棕色，木部淡黄色。气微，味微甜后苦。续断（E错）：【性状鉴别】药材呈长圆柱形，略扁，有的微弯曲。表面灰褐色或黄褐色，有稍扭曲或明显扭曲的纵皱及沟纹，可见横裂的皮孔样斑痕及少数须根痕。质软，久置后变硬，易折断，断面不平坦，皮部墨绿色或棕色，横切面外缘褐色或淡褐色，木部黄褐色，导管束呈放射状排列。气微香，味苦、微甜而后涩。